义齿固位力与卡环臂进入基牙倒凹的深度和倒凹的坡度的关系
A. 进入倒凹深，倒凹坡度大，固位力强
B. 进入倒凹深，倒凹坡度小，固位力强
C. 进入倒凹浅，倒凹坡度大，固位力强
D. 进入倒凹浅，倒凹坡度小，固位力强
E. 固位力和倒凹深度和坡度无关

正确答案：A。进入倒凹深，倒凹坡度大，固位力强

解析：本题考查义齿固位力与卡环臂进入基牙倒凹的深度和倒凹的坡度的关系。义齿固位力与卡环臂进入基牙倒凹的深度和倒凹的坡度的关系为进入倒凹深，倒凹坡度大，固位力强（A对）。义齿的固位力与摩擦力、吸附力、表面张力和大气压力有关，而最重要的是摩擦力，摩擦力主要表现为卡环臂的弹性卡抱力、导平面与导平面板接触产生的摩擦力以及各部件的制锁力。卡抱固位力的大小和固位倒凹的深度、坡度、固位卡臂的弹性有关（E错）。卡环臂进入基牙倒凹的深度越深，倒凹坡度越大，产生的正压力越大，则正压力产生的抵抗脱位力的摩擦力就越大，固位力就越强（A对B错）；同理，进入倒凹浅，坡度小，固位力弱（CD错）。